使用以下药物处理浅龋病损时，能够引起牙齿变色的药物是
A. 75%氟化钠甘油糊剂
B. 8%氟化亚锡溶液
C. 1.5%含氟凝胶
D. 10%硝酸银
E. 再矿化液

正确答案：D。10%硝酸银

解析：硝酸银溶液处理浅龋病损时，可生成黑色沉淀物质使牙齿变黑。掌握“龋病的治疗原则与非手术治疗方法”知识点。